为研究某电镀厂附近地区人群慢性镉中毒的患病率及其分布特点，在该电镀厂排放污水河流下游的5个村庄进行调查，每个村子各选取在当地居住5年以上，无职业性镉接触史的居民约200人，进行体检并填写健康调查问卷。此种研究属于
A. 病例报告
B. 现况研究
C. 生态学研究
D. 个案研究
E. 随访研究

正确答案：B。现况研究

解析：本题考查现况研究。现况研究（B对ACDE错）是研究特定时点或时期与特定范围内人群中的有关变量（因素）与疾病或健康状况的关系，即是调查这个特定的群体中的个体是否患病和是否具有某些变量或特征的情况，从而探索具有不同特征的暴露与非暴露组的患病情况或是否患病组的暴露情况。